女，89岁，坠落伤，T12压缩1/3～3/4，保守治疗一月未见好转，下一步治疗
A. 前位椎体置换
B. 椎间盘置换术
C. 经皮穿刺椎体成形术
D. 切开复位钢钉固定
E. 继续卧床制动

正确答案：C。经皮穿刺椎体成形术

解析：患者89岁（高龄），坠落伤，T12压缩1/3～3/4，保守治疗一月未见好转（提示胸腰椎损伤保守治疗），因患者高龄，常伴有骨质疏松，下一步治疗应选择经皮穿刺椎体成形术（C对）；前位椎体置换（A错）、切开复位钢钉固定（D错）用于合并急性椎间盘突出骨折脱位；椎间盘置换术（B错）常用于保守治疗无效的椎间盘突出症；继续卧床制动（E错）为保守治疗，该患者保守治疗一个月无效，故E选项错误。